以下关于钉道位置的说法不正确的是
A. 在釉牙本质界以内0.5～1.0mm
B. 最好在轴角处制备
C. 距洞壁至少0.5mm以上
D. 钉道间距离在2mm左右即可
E. 钉道方向应与牙轴面平行

正确答案：D。钉道间距离在2mm左右即可

解析：本题考查钉洞固位形。关于钉道位置的说法不正确的是钉道间距离在2mm左右即可（D错，为本题的正确答案）。钉道要有适宜的深度，过浅修复体固位不足，过深易损伤牙髓，适宜深度为釉牙本质界以内0.5～1.0mm（A对）。轴角处釉质较厚，最好在轴角处制备（B对），可减少对牙髓的损伤。钉道距洞壁应有一定的距离，以保证牙体组织的强度防止折裂，距洞壁至少0.5mm以上（C对）。为增强固位，钉道分布越分散，可获得的固位力越大。钉道方向应尽量与牙轴面平行（E对），以免穿髓，且利于就位，即与就位道平行。